上市后药品在评价阶段属于
A. 一期临床试验
B. 二期临床试验
C. 三期临床试验
D. 四期临床试验
E. 零期临床试验

正确答案：D。四期临床试验

解析：本题考查新药临床试验。Ⅳ期临床试验（D对）是在新药上市后由申请人自主进行的应用研究阶段，其目的是考查在广泛使用条件下的药物的疗效和不良反应、评价在普通或者特殊人群中使用的利益与风险关系、改进给药剂量等。Ⅰ期临床试验（A错）是为了观察人体对于新药的耐受程度和药动学，为制订给药方案提供依据。Ⅱ期临床试验（B错）是为了初步评价药物对目标适应证患者的治疗作用和安全性，也包括为Ⅲ期临床试验研究设计和给药剂量方案确定提供依据。Ⅲ期临床试验（C错）是为了进一步验证药物对目标适应证患者的治疗作用和安全性，评价利益和风险关系，最终为药物注册申请获得批准提供充分的依据。零期临床试验（E错）是在新药研究完成临床前试验、但还未正式进入正式的临床试验之前，FDA容许新药研制者使用微剂量（一般不大于100微克，或小于1%的标准剂量）在少量人群（10人左右）进行药物试验，以收集必要的有关药物安全及药代动力学的试验数据。其目的在于加快新药进入市场的速度。